上颌窦底壁距上颌哪颗牙的根尖最近
A. 上颌第一前磨牙
B. 上颌第二前磨牙
C. 上颌第一磨牙
D. 上颌第二磨牙
E. 上颌第三磨牙

正确答案：C。上颌第一磨牙

解析：上颌窦与牙根尖的关系：上颌窦位于上颌骨内，上颌窦的底壁由前向后盖过上颌第二前磨牙到上颌第三磨牙的根尖，与上述牙根尖之间隔以较薄的骨质，甚至无骨质而仅覆以黏膜。其中以上颌第一磨牙根尖距上颌窦底壁最近，上颌第二磨牙次之，第二前磨牙与第三磨牙再次之。掌握“上颌骨解剖特点”知识点。